固体分散物的特点不包括
A. 可延缓药物的水解和氧化
B. 可掩盖药物的不良气味和刺激性
C. 可提高药物的生物利用度
D. 采用水溶性载体材料可达到缓释作用
E. 可使液态药物固体化

正确答案：D。采用水溶性载体材料可达到缓释作用

解析：本题考查固体分散物的特点。固体分散物能够利用不同性质的载体使药物在高度分散状态下达到不同要求。采用水溶性载体可达到迅速溶解与吸收作用（D错，为本题正确答案）；采用难溶性载体可达到缓释作用，提高药物的生物利用度（C对）；固体分散物利用载体的包蔽作用，可延缓药物的水解和氧化（A对）；掩盖药物的不良气味和刺激性（B对）；使液态药物固体化（E对）。